抗甲状腺药碘化钾所致不良反应
A. 粒细胞计数减少
B. 体位性低血压
C. 性功能降低
D. 淋巴结肿大
E. 视物模糊

正确答案：D。淋巴结肿大

解析：本题考查碘化钾的不良反应。淋巴结肿大（D对）是抗甲状腺药碘化钾的不良反应。抗甲状腺药物碘化钾的主要不良反应有：过敏、发热、红斑、关节痛、淋巴结肿大、腹泻、腹痛等。造成粒细胞减少（A错）、体位性低血压（B错）、性功能降低（C错）、视物模糊（E错）均不是碘化钾的不良反应。